泡腾片剂
A. 严禁直接口服
B. 禁用于红肿部位
C. 使用后不宜马上饮水
D. 一般应整片吞服
E. 保持舌下含服至少5分钟，仰卧姿势约20分钟

正确答案：A。严禁直接口服

解析：本题考查各种剂型的正确使用。泡腾片严禁直接口服（A对）。泡腾片服用时应注意：①供口服的泡腾片一般宜用100～150ml凉开水或温水浸泡，可迅速崩解和释放药物，应待完全溶解或气泡消失后再饮用；②不应让幼儿自行服用；③严禁直接服用或口含；④药液中有不溶物、沉淀、絮状物时不宜服用。使用透皮贴剂时宜注意：皮肤有破损、溃烂、渗出、红肿的部位不要贴敷（B错）。含漱剂多为水溶液，含漱后不宜马上饮水（C错）和进食，以保持口腔内药物浓度。服用缓、控释制剂的药片或胶囊时，除另有规定外，一般应整片或整丸吞服（D错），严禁嚼碎和击碎分次服用。舌下片含服时间一般控制在5min左右（E错），以保证药物充分吸收。